关于滴虫性阴道炎叙述不正确的是
A. 传播方式有直接传播或间接传播
B. 主要症状是阴道分泌物增多及外阴瘙痒
C. 阴道分泌物为常为稀薄液体或黄绿色脓性分泌物
D. 主要治疗药物为红霉素
E. 潜伏期为4～28日

正确答案：D。主要治疗药物为红霉素

解析：滴虫性阴道炎潜伏期为4～28日（E对）；其传播方式有（性交）直接传播或间接传播（A对）；主要症状是阴道分泌物增多及外阴瘙痒（B对）；阴道分泌物常为稀薄液体或黄绿色脓性分泌物（C对）；主要治疗药物为硝基咪唑类药物，例如甲硝唑及替硝唑，而不是红霉素（D错，为本题正确答案）。